氟中毒症状不包括
A. 氟牙症
B. 恶心、呕吐
C. 阵发性心律失常
D. 腹泻甚至肠道出血
E. 心、肝、肾器质性损害

正确答案：C。阵发性心律失常

解析：急性氟中毒：一次性大量误服氟化物，可造成急性氟中毒，主要症状是恶心、呕吐、腹泻甚至肠道出血等；重者引起心、肝、肾器质性损害，以致昏迷。患者通常可在4小时内或死亡、或康复，这一关键时期是非常短的。慢性氟中毒：机体长期摄入过量的氟可导致慢性氟中毒。根据氟来源的不同，慢性氟中毒可分为地方性氟中毒和工业氟中毒。慢性氟中毒的主要临床表现是氟牙症、氟骨症。氟骨症主要表现为骨质硬化和骨旁软组织骨化。掌握“氟毒性及氟牙症”知识点。